面动脉的压迫止血点通常在
A. 口角外侧
B. 颧弓后端
C. 鼻翼外侧
D. 咬肌前缘与下颌骨下缘交点处
E. 咬肌后缘与下颌角处

正确答案：D。咬肌前缘与下颌骨下缘交点处

解析：咬肌前缘与下颌骨下缘交点处（D对）的面动脉位置表浅，为面动脉的压迫止血点。